与奥美拉唑-替硝唑三联治疗胃溃疡
A. 红霉素
B. 罗红霉素
C. 克拉霉素
D. 克林霉素
E. 四环素

正确答案：C。克拉霉素

解析：本题考查三联治疗胃溃疡。克拉霉素（C对）主要用于敏感菌引起的感染，与奥美拉唑和甲硝唑三联治疗胃溃疡，效率较高。β-内酰胺类药物，与红霉素（A错）联合应用，一般认为可发生降效作用。罗红霉素（B错）不与麦角胺、二氢麦角胺、溴隐亭、特非那定、酮康唑及西沙必利配伍。克林霉素（D错）与阿片类镇痛药合用，可能使呼吸中枢抑制现象加重。四环素（E错）与制酸药如碳酸氢钠同用时，由于胃内pH值增高，可使该品吸收减少，活性减低，故服用该品后1～3小时内不应服用制酸药。